男，54岁。20天内呕血2次，之后大便发黑。乙肝病史30年。贫血貌，浅表淋巴结未触及，皮肤蜘蛛痣和出血点。腹软，肝未触及，脾肋下4cm，腹水征（+）。肾功能正常。胃镜检查见食管静脉曲张。最适宜的治疗方法是
A. 远端脾肾静脉分流术
B. 脾切除、胃底食管下端周围血管离断术
C. 脾切除、脾肾静脉分流术
D. 门腔静脉侧侧吻合分流术
E. 经颈静脉肝内门体分流术

正确答案：B。脾切除、胃底食管下端周围血管离断术

解析：患者乙肝病史30年，脾肿大，有腹水，诊断为肝炎后肝硬化，门脉高压症。多次呕血，胃镜见食管静脉曲张，诊断为胃底食管曲张静脉破裂出血。由于患者有腹水，肝功能属于Child-Pugh B或C级，为预防和控制胃底食管下端曲张静脉破裂出血，应首选贲周血管离断术。患者脾大，一般合并脾功能亢进，故应行脾切除术，即脾切除+胃底食管下端周围血管离断术（B对）。分流术风险大，死亡率高，目前临床上已很少施行分流术（ACDE错）。